患者，女，14岁。进食海虾后，全身发出瘙痒性风团，突然发生，并迅速消退，不留痕迹，皮疹色赤，遇热则加剧，得冷则减轻，舌苔薄黄，脉浮数。治疗应首选
A. 桂枝汤
B. 消风散
C. 防风通圣散
D. 桑菊饮
E. 银翘散

正确答案：B。消风散

解析：瘾疹，是一种皮肤出现红色或苍白色风团，时隐时现的瘙痒性、过敏性皮肤病，相当于西医的荨麻疹，其特点是皮肤上出现瘙痒性风团，发无定处，骤起骤退，退后不留痕迹，本病例有进食海虾的诱因，皮疹特点与之相符，故诊断为瘾疹，风热外袭，客于肌表，出现瘾疹；遇热则助邪更甚，皮疹加剧，得冷则邪热暂时减轻，病情稍缓；舌苔薄黄，脉浮数，为风热之象，故证型为 风热犯表证，宜疏风清热止痒，用消风散加减（B对）。桂枝汤，或麻黄桂枝各半汤用于风寒证（A错）。防风通圣散用于胃肠湿热证（C错）。桑菊饮，具有疏风清热、宣肺止咳的作用，用于风温咳嗽轻证（D错）。银翘散，具有疏风清热的作用，用于疮疡焮红肿痛，邪气在表，头昏少汗，发热重、恶寒轻者（E错）。